男，60岁。晨醒后左侧肢体无力，刷牙时无法拿杯。有糖尿病和高血压史，无心脏病史。半天后急诊入院。查体：左侧肢体肌力3级，腱反射高于右侧，左侧Babinski征阳性，左侧肢体痛温觉减退。可能的诊断是
A. 脑转移癌
B. 脑栓塞
C. 短暂性脑缺血发作
D. 脑血栓形成
E. 髙血压性脑出血

正确答案：D。脑血栓形成

解析：本例患者老年男性，晨醒后发现左侧肢体无力，查体:左侧肢体肌力3级，腱反射高于右侧，左侧Babinski征阳性，左侧肢体痛温觉减退，有糖尿病和高血压史，应考虑脑血栓形成（D对）。脑血栓形成多见于中老年，一般有高血压、糖尿病等血管慢性损害疾病，多有肢体麻木、无力等短暂性脑缺血发作（TIA）前驱症状，患者一般意识清楚，临床表现因血栓形成部位不同而异。脑转移癌（A错）的患者会有原发癌灶的表现，会因颅内压增高有突发头痛、呕吐等症状。脑栓塞（B错）以青壮年多见，多在活动中急骤发病，无前驱症状，多表现为完全性卒中，且有栓子来源病史（P185）。短暂性脑缺血发作（C错）症状持续时间一般仅数分钟到数小时，过后完全正常，无后遗症状（P173）。高血压性脑出血（E错）多在情绪激动或活动中突然发病，前驱症状一般不明显，有明显头痛、呕吐症状（P189）。